患儿，女，5岁。因右侧腮部肿痛5天就诊，现症见腮部漫肿，灼热疼痛，咀嚼尤甚，精神倦怠，高热头痛，咽喉肿，大便干结，小便短赤，舌质红，苔黄腻，脉滑数。其首选方剂是
A. 仙方活命饮
B. 普济消毒饮
C. 黄连解毒汤
D. 三仁汤
E. 银翘散

正确答案：B。普济消毒饮

解析：该患儿以右侧腮部漫肿，灼热疼痛，咀嚼尤甚为主症，故诊断为流行性腮腺炎。流行性腮腺炎是由腮腺炎病毒所引起的急性呼吸道传染病，临床以腮腺肿胀、疼痛为主要的特征。患儿”高热头痛，咽喉肿，大便干结，小便短赤，舌质红，苔黄，脉数“，提示有热邪炽盛--热毒壅阻少阳经脉，凝聚耳下，故腮部漫肿，灼热疼痛，咀嚼尤甚；邪毒内蕴，正气耗损，故精神倦怠；热毒入里，邪热炽盛，故高热头痛，咽喉肿；热灼津液，肠腑失润，故大便干结，小便短赤；舌质红，苔黄腻，脉滑数，为热毒蕴结之象，故当治以清热解毒，软坚散结，宜选清热解毒，疏风散邪的普济消毒饮加减（B对）。仙方活命饮（A错）功用为清热解毒，消肿溃坚，活血止痛，适用于阳证痈疡肿毒初起。黄连解毒汤（C错）功用为泻火解毒，适用于三焦火毒证。三仁汤（D错）功用为宣畅气机，清利湿热，适用于湿温初起及暑温夹湿之湿重于热证。银翘散（E错）功用为辛凉透表，清热解毒，适用于温病初起。